CCl₄染毒大鼠100只中有50只GPT升高，即效应发生率为50%，此为
A. 效应
B. 反应
C. 剂量-效应（反应）关系
D. 有的个体不遵循剂量（效应）反应关系规律

正确答案：B。反应

解析：本题考查反应。反应又称质反应，指在暴露某一化学物的群体中，出现某种效应的个体在群体中所占比率，一般以百分率或比值表示。CCl₄染毒大鼠100只中有50只GPT升高，即效应发生率为50%，此为反应（B对ACD错）。